在一项吸烟与肺癌关系的病例对照研究中，如果对照组中选入过多的慢性支气管炎患者，则计算得到的
A. RR值可能高于真实值
B. RR值可能低于真实值
C. OR值可能高于真实值
D. OR值可能低于真实值
E. 对结果影响不大

正确答案：D。OR值可能低于真实值

解析：本题考查比值比的相关内容。比值比（OR）为病例组与对照组两组暴露比值之比。因为慢性支气管炎与吸烟有关联，所以选取慢性支气管炎患者会增加对照组中吸烟的暴露比例，即b值，本题中如果对照组中选入过多的慢性支气管炎患者，则计算得到的OR值可能低于真实值（D对ABCE错）。